以PEG6000为基质制栓，润滑剂应选用
A. 液状石蜡
B. 软肥皂
C. 乙醇
D. 肥皂醑
E. 甘油

正确答案：A。液状石蜡

解析：本题考查栓剂的制备。以PEG6000为基质制栓，润滑剂应选用液状石蜡（A对）。栓模润滑剂的选用：为便于脱模，制备时常需在模孔内涂布润滑剂，有些基质本身不黏模，可不用润滑剂，如可可豆脂、聚乙二醇类。所用的润滑剂通常有两类：①用于油脂性基质的润滑剂：软肥皂（B错）、甘油（E错）各1份与90%乙醇（C错）5份混合制成的醇溶液；②用于水溶性基质的润滑剂：液状石蜡或植物油等油类物质。